患者，女，21岁，未婚。月经不定期，经期延长，量时多时少已2年余。查体：外阴发育正常，宫体较小，前次月经约行50天方净，本次又值经期，已4天，量多如注，色鲜红，质稍稠，腰膝酸软，头晕耳鸣，心烦口干，舌红，少苔，脉细数。应首选的方剂是
A. 固本止崩汤
B. 左归丸合二至丸
C. 清热固经汤
D. 固经丸
E. 保阴煎

正确答案：B。左归丸合二至丸

解析：本题患者月经不定期经期延长，量时多时少可诊断为异常子宫出血，因肾阴虚火旺，迫血妄行，则量多如注，色鲜红。肾阴不足，脑、骨、耳窍失养，则腰膝酸软，头晕耳鸣。心肾为水火相济之脏，肾水亏虚，不能上承于心，水火失济，心神不宁，则心烦。肾阴亏虚，阴不制阳，虚火内生，则口干。舌红，少苔，脉细数，为阴虚内热之象，所以宜用左归丸合二至丸（B对）；固本止崩汤具有补气摄血，固冲调经的功效，用于脾虚证，证候∶经血非时暴下不止，或淋沥不断，色淡质稀，神倦懒言，面色胱白，不思饮食，或面浮肢肿。舌淡胖、边有齿痕，苔薄白，脉缓无力（A错）；清热固经汤清热凉血，止血调经的功效，用于治疗实热证，证候∶经血非时暴下不止，或淋沥日久不断，色深红，质稠，心烦面赤。舌红苔黄，脉滑数（C错）；固经丸具有滋阴清热，固经止血之功效，主治崩漏的阴虚血热证，症见阴虚血热，月经先期，月经过多，赤白带下或崩中漏下，血色深红或紫黑稠黏，手足心热，腰膝酸软，舌红，脉弦（D错）；保阴煎具有滋阴清热，止血调经的功效，用于治疗虚热证，证候：经乱无期，量少淋沥不净或量多势急，血色鲜红，质稠，口燥咽干，心烦潮热，大便干结。舌红少苔，脉细数（E错）。